属于噪声敏感建筑物的是
A. 候机楼、候车厅
B. 医院、学校
C. 影院、歌厅
D. 商场、酒店
E. 室内健身场馆

正确答案：B。医院、学校

解析：本题考查噪声敏感建筑物。噪声敏感建筑物是指医院、学校（B对ACDE错）、机关、科研单位、住宅等需要保持安静的建筑物。